男，40岁。间断喘憋1年余。活动量多时较明显，2天来喘憋明显加重，在夜间憋醒。1周前咽痛，发热，服用“感冒药”后好转，既往：心脏有杂音，具体情况不详，查体：T38.2℃，BP130/40mmHg，高枕卧位，双肺可闻及细湿啰音，心界向左下扩大，心率80次/分，律齐，主动脉瓣第—听诊区可闻及收缩期杂音，主动脉瓣第二听诊区可间及舒张期吹风样递减型杂音。尿常规检查可见镜下血尿。为进—步明确诊断，应重点选择检查
A. 胸部X线片
B. 免疫学检查
C. 心电图
D. 心肌酶
E. 血培养

正确答案：E。血培养

解析：患者中年男性，间断喘憋1年余，活动量多时较明显（劳力性呼吸困难）。1周前有上感病史，2天来喘憋明显加重，在夜间憋醒（夜间阵发性呼吸困难），提示患者心衰加重。查体，T38.2℃（正常<37.5℃），考虑感染性发热，BP130/40mmHg（正常90-120/60-90mmHg）。既往心脏有杂音，现主动脉听诊提示主动脉瓣狭窄伴关闭不全，瓣膜病为亚急性心内膜炎的重要病因。尿常规检查可见镜下血尿，提示体内感染可能迁移至肾。综合患者病史和临床表现，考虑患者患感染性心内膜炎（IE），而血培养是诊断IE的最重要方法（E对）。IE的临床表现缺乏特异性，超声心动图和血培养是诊断IE的两大基石，而胸部X线片（A错）、免疫学检查（B错）、心电图（C错）、心肌酶（D错）等都可用于辅助诊断，有一定意义，但不能用于确诊。